患者头痛眩晕半年余，痛时有空虚感，时发时止，腰酸腰腿，四肢不温，舌淡，脉沉细。最佳治疗方剂是
A. 右归丸
B. 大补元煎
C. 杞菊地黄丸
D. 天麻钩藤饮
E. 川芎茶调散

正确答案：B。大补元煎

解析：脑为髓海，其主在肾，现肾虚髓不上荣，脑海空虚，故见头痛眩晕半年余，痛时有空虚感，时发时止；腰为肾之府，肾虚则腰酸腰腿；阳虚不能温煦则四肢不温；舌淡，脉沉细，均为肾虚的表现，治疗需补肾填精，代表方为大补元煎加减（B对）。右归丸（A错）温补肾阳，填精益髓，用于治疗肾阳虚头痛。杞菊地黄丸（C错）滋补肝肾，益精明目，用于治疗肝肾阴虚，目视不明。天麻钩藤饮（D错）平肝潜阳，用于治疗肝阳头痛。川芎茶调散（E错）疏风散寒，用于治疗风寒头痛。